参与经典途径激活补体的是
A. IgE
B. LPS
C. IgD
D. IgA
E. IgM

正确答案：E。IgM

解析：补体是一个具有精密调控机制的蛋白质反应系统，其固有成分以非活化形式存在于体液中，通过级联酶促反应而被激活，产生具有生物学活性的产物。补体有三条激活途径（经典途径、旁路途径和MBL途径），其中经典途径指激活物与C1q结合，导致C1r、C1s等相继激活，形成攻膜复合物。经典途径的激活物主要是与抗原结合的IgG、IgM（E对ACD错）分子，且只有当IgG、IgM与抗原结合，发生构型的改变，暴露出补体结合部位后，才能与C1q结合。LPS（B错）即内毒素，为旁路激活途径的激活物。